药物的作用靶点有
A. 受体
B. 酶
C. 离子通道
D. 核酶转运体
E. 基因

正确答案：A、B、C、D、E。受体；酶；离子通道；核酶转运体；基因

解析：本题考查药物的作用靶点。药物与机体结合的部位就是药物作用的靶点，包括受体（A对）、酶（B对）、离子通道（C对）、核酶转运体（D对）、基因（E对）等。